八珍益母丸的功能
A. 滋阴清热，除烦安神
B. 益气养血，活血调经
C. 滋阴补血，调经疏郁
D. 补气养血，调经止带

正确答案：B。益气养血，活血调经

解析：本题考查八珍益母丸的功能。八珍益母丸的功能是益气养血，活血调经（B对）。八珍益母丸（胶囊）【功能】益气养血，活血调经。更年安片（胶囊）【功能】滋阴清热，除烦安神（A错）。四物合剂【功能】补血调经（C错）。乌鸡白凤丸（片）【功能】补气养血，调经止带（D错）。七制香附丸【功能】舒肝理气，养血调经（E错）。